苯丙酮尿症属于
A. 染色体畸变
B. 常染色体显性遗传
C. 常染色体隐性遗传
D. X连锁显性遗传
E. X连锁隐性遗传

正确答案：C。常染色体隐性遗传

解析：苯丙酮尿症属于常染色体隐性遗传（C对）。先天性苯丙氨酸羟化酶缺陷患者，不能将苯丙氨酸羟化为酪氨酸，苯丙氨酸经转氨基作用大量生成苯丙酮酸，大量的苯丙酮酸及其部分代谢产物由尿排出，成为苯丙酮酸尿症。